男性，47岁。右下颌后牙出现反复肿痛3个月求治。口腔检查：右下8萌出不全，远中有盲袋，冠周无明显炎症。X线片示：右下8横向生长，牙冠朝向右下7远中根，牙根距离下颌管2mm，无明显龋坏。右下8阻生类型为
A. 近中阻生
B. 水平阻生
C. 远中阻生
D. 倒置阻生
E. 颊向阻生

正确答案：B。水平阻生

解析：本题考查下颌阻生第三磨牙Winter分类。水平阻生（B对）为智齿牙长轴与下颌第二磨牙长轴接近垂直，在颌骨内横向生长，牙冠朝向近中，牙根朝向远中。近中阻生（A错）为智齿牙冠向下颌第二磨牙的近中，牙根向下颌牙的远中；反之为远中阻生（C错）。智齿牙冠朝向下颌牙的根方，牙根朝向下颌牙的冠方时称倒置阻生（D对）。颊向阻生（E错）为智齿牙冠朝向颊侧，根方朝向舌侧。